男性，42岁。4年来经常腹胀、下肢浮肿，前胸有蜘蛛痣，腹水，肝未触及，脾大。应首先考虑的是
A. 普通型病毒性肝炎
B. 门脉性肝硬化
C. 酒精性肝炎
D. 肝细胞肝癌
E. 慢性肝淤血

正确答案：B。门脉性肝硬化

解析：患者中年男性，四年来有腹胀（肝功能减退致消化吸收不良）、下肢浮肿（出现肝源性水肿），前胸有蜘蛛痣（肝硬化导致雌激素灭活减少），腹水、脾大（出现门静脉高压症），综合该患者的病史、体查，该患者诊断考虑为门脉性肝硬化（B对）。普通型病毒性肝炎（八版传染病学P29）（A错）主要表现为全身乏力、食欲减退、厌油、黄疸和肝区不适等，触诊肝大，伴轻压痛、叩痛。酒精性肝炎（P410）（C错）常发生于近期大量饮酒后，主要表现为食欲不振、恶心呕吐、肝区疼痛等，可伴低热、黄疸，查体见肝大并有触痛。肝细胞肝癌（P430）（D错）可继发于门脉性肝硬化，但患者多有肝区疼痛、肝脏进行性增大表现，触诊见肝脏表面有大小不等的结节，伴有压痛。慢性肝淤血（八版病理学P46-P47）（E错）常因右心衰竭导致，肝脏因血液淤积而肿大，但肝小叶改建不明显，故不引起门脉高压，查体同时见右心衰体征，如右心室扩大、闻及三尖瓣关闭不全的反流性杂音等（P167）。